吸烟与肺癌关系的许多研究都是前瞻性队列研究，最初调查过吸烟情况研究对象中有一部分后来失访了，这些失访者
A. 应从研究中剔除出去
B. 只在随机化试验中才影响结果
C. 因为进入研究时存在选择偏性，可得出不正确的相对危险度估计值
D. 其被随访到的那段时间应包括在暴露人年中
E. 只有当这些失访者具有较高的肺癌危险度时，才会得出有偏差的相对危险度的估计值

正确答案：D。其被随访到的那段时间应包括在暴露人年中